用滤纸滤膜阻流法通常采集
A. 气态物质
B. 气溶胶态物质
C. 雾态物质
D. 蒸汽态物质
E. 固体物质

正确答案：B。气溶胶态物质

解析：本题考查滤纸滤膜阻流法。滤纸滤膜阻流法是一种常用的采集气溶胶态物质（B对ACDE错）的方法，其工作原理是：将滤纸滤膜放置在一个容器中，将待测样品放入容器中，然后通过滤纸滤膜的阻力，将气溶胶中的微粒捕获，并将其转化为可测量的物质。